交感神经
A. 分为运动纤维和感觉纤维
B. 低级中枢位于脊髓Tl-L3节段
C. 节前纤维经灰交通支返回脊神经
D. 节后纤维仅分布于躯干、四肢
E. 与副交感神经合称为内脏神经

正确答案：B。低级中枢位于脊髓Tl-L3节段

解析：交感神经属于内脏运动神经，含内脏运动纤维（A错），与副交感神经合称为内脏运动神经（E错），其低级中枢（节前神经元的胞体）位于脊髓Tl-L3节段的灰质侧柱的中间外侧核（B对），椎旁神经节由交感神经低级中枢发出的一部分节前纤维经脊神经前根和前支止于脊柱两旁的交感神经节（C错）。